依据《最高人民法院、最高人民检察院关于办理生产、销害伪劣商品刑事案件具体应用法律若干问题的解释》，下面应认定为“足以严重危害人体健康”的是
A. 生产、销售的有毒有害食品被食用后，造成特别严重后果的
B. 生产、销售的不符合卫生标准的食品被人食用后，造成特别严重后果的
C. 生产、销售的假药不含所标明的有效成份，可能贻误诊治的
D. 生产、销售的假药被使用后，致人严重残疾，造成特别严重后果的
E. 生产、销售的有毒有害食品被食用后，致人严重残疾、三人以上重伤的

正确答案：C。生产、销售的假药不含所标明的有效成份，可能贻误诊治的

解析：本题考查消费者协会的职能。对损害消费者合法权益的行为，通过大众传播媒介予以揭露批评是消费者协会的职能（D对）。消费者享有依法成立维护自身合法权益的社会组织的权利。消费者协会和其他消费者组织是依法成立的对商品和服务进行社会监督的保护消费者合法权益的社会组织。消费者协会履行下列公益性职责：一是向消费者提供消费信息和咨询服务，提高消费者维护自身合法权益的能力，引导文明、健康、节约资源和保护环境的消费方式；二是参与制定有关消费者权益的法律、法规、规章和强制性标准；三是参与有关行政部门对商品和服务的监督、检查；四是就有关消费者合法权益的问题，向有关部门反映、查询，提出建议；五是受理消费者的投诉，并对投诉事项进行调查、调解；六是投诉事项涉及商品和服务质量问题的，可以委托具备资格的鉴定人鉴定，鉴定人应当告知鉴定意见；七是就损害消费者合法权益的行为，支持受损害的消费者提起诉讼或者依照法律提起诉讼；八是对损害消费者合法权益的行为，通过大众传播媒介予以揭露、批评。消费者协会应当认真履行保护消费者合法权益的职责，听取消费者的意见和建议，接受社会监督。各级人民政府对消费者协会履行职责应当予以必要的经费等支持。依法成立的其他消费者组织依照法律、法规及其章程的规定，开展保护消费者合法权益的活动。行业协会的职能（E错）包括：组织职能、协调职能、服务职能、监管职能。